违反药品管理法规定，提供虚假证明或者采取欺骗手段取得药品生产、经营许可证的，除吊销许可证外，还应
A. 责令停产、停业整顿，并处五千元以上二万元以下的罚款
B. 处二万元以上十万元以下的罚款
C. 十年内不受理其相应申请，并处五十万元以上五百万元以下的罚款
D. 责令改正，给予警告，对单位并处三万元以上五万元以下的罚款
E. 给予降级、撤职、开除处分，并处三万元以下的罚款

正确答案：C。十年内不受理其相应申请，并处五十万元以上五百万元以下的罚款

解析：本题考查违反药品监督管理规定的法律责任。违反药品管理法规定，提供虚假证明或者采取欺骗手段取得药品生产、经营许可证的，除吊销许可证外，还应十年内不受理其相应申请，并处五十万元以上五百万元以下的罚款（C对）。根据《药品管理法》第123条的规定，提供虚假的证明、数据、资料、样品或者采取其他手段骗取临床试验许可、药品生产许可、药品经营许可、医疗机构制剂许可或者药品注册等许可的，撤销相关许可，十年内不受理其相应申请，并处五十万元以上五百万元以下的罚款；情节严重的，对法定代表人、主要负责人、直接负责的主管人员和其他责任人员，处二万元以上二十万元以下的罚款，十年内禁止从事药品生产经营活动，并可以由公安机关处五日以上十五日以下的拘留。